患者25岁，男性，因右下后牙进食冷热食物痛1周，无自发痛，夜间痛史。检查：右下7颊面龋洞，探稍敏感，叩（-），松（-），牙龈（-），冷热测同对照牙。右下6颊面龋洞，探敏感，叩（-），松（-），牙龈（-），冷热测引起疼痛，去除后立即消失。其余牙未见异常，做温度测验时，选择对照牙最好为
A. 右上67
B. 左下67
C. 左上67
D. 右下58
E. 右下45

正确答案：B。左下67

解析：本题考查温度测验时对照牙的选择。温度测验时，选择对照牙的顺序为：首选对侧正常同名牙，其次为对颌同名牙，最后为与可疑牙处在同一象限的健康邻牙。该患者患牙为右下67，所以首先选择对侧正常同名牙即左下67（B对）。